女，37岁。交通事故中右下肢受伤3小时。查体：右下肢缩短，右髋关节呈屈曲、内收、内旋畸形，右足背麻木，背屈无力。最可能的诊断是
A. 髋关节中心脱位、坐骨神经损伤
B. 髋关节前脱位、坐骨神经损伤
C. 髋关节前脱位、闭孔神经损伤
D. 髋关节后脱位、股神经损伤
E. 髋关节后脱位、坐骨神经损伤

正确答案：E。髋关节后脱位、坐骨神经损伤

解析：患者有右下肢外伤史，右髋关节呈屈曲、内收、内旋畸形，应诊断为右髋关节后脱位。右足背麻木、背屈无力，提示可能合并有坐骨神经损伤（髋关节后脱位合并坐骨神经损伤者，多表现以腓总神经损伤为主的体征，出现足下垂、趾背伸无力和足背外侧感觉障碍等），故该患者最可能的诊断是髋关节后脱位，坐骨神经损伤（E对）。髋关节中心脱位（A错）表现为髋部肿胀、疼痛、活动障碍，大腿上段外侧方往往有大血肿，常合并出血性休克及腹部内脏损伤。髋关节前脱位（BC错）表现为患肢外展、外旋和屈曲畸形。股神经损伤（P701）（D错）后主要表现为股四头肌麻痹所致的膝关节伸直障碍和小腿内侧感觉障碍。